关于学校健康教育正确的是
A. 其根本目的是使学生获得必要的卫生知识
B. 其内容主要是个人卫生习惯与健康
C. 其评价方法只有问卷调查和访谈
D. 其评价指标主要针对知、信、行三方面
E. 参与式教育方法以教师为主导，以活动为主要形式

正确答案：D。其评价指标主要针对知、信、行三方面